急性肺水肿最特异的临床表现为
A. 肺动脉瓣区第二心音亢进
B. 心尖区收缩期杂音
C. 咳大量粉红色泡沫痰
D. 左肺底湿啰音
E. 气促、发绀

正确答案：C。咳大量粉红色泡沫痰

解析：左心衰时，血液瘀滞于肺部，咳白色浆液性泡沫痰，当伴发急性肺水肿时，肺微血管静水压力升高、通透性增加，血液中的液体及少量红细胞进入肺泡，形成粉红色泡沫痰。因此急性肺水肿最特异的临床表现为咳大量粉红色泡沫痰（C对）。肺动脉瓣区第二心音亢进（A错）可见于肺源性心脏病、左向右分流的先天性心脏病、二尖瓣狭窄伴肺动脉高压等疾病。急性肺水肿一般无心尖区收缩期杂音（B错）。左肺底湿啰音（D错）在急性肺水肿时可出现，但也可见于肺炎等肺部疾病，不具特异性。气促发绀（E错）为缺氧时的表现，并无特异性。